入汤剂宜先煎的药物是
A. 人参
B. 当归
C. 黄芪
D. 杜仲
E. 石斛

正确答案：E。石斛

解析：在第五版教材中石斛的用法为入汤剂宜先煎（E对），值得注意的是在第七版和第九版教材中石斛入汤剂没提到需要先煎。